布洛芬的作用机制是抑制体内的
A. 环氧酶
B. 前列腺素
C. 白三烯
D. 垂体激素
E. 肾上腺激素

正确答案：A。环氧酶

解析：布洛芬的作用机制主要是通过抑制环氧酶，抑制PGs的产生，故有明显的抗炎、解热、镇痛作用。掌握“对乙酰氨基酚、布洛芬、塞来昔布”知识点。